用于虚寒性出血病证，对妇女崩漏下血尤为适宜的药物是
A. 白茅根
B. 大蓟
C. 地榆
D. 艾叶
E. 蒲黄

正确答案：D。艾叶

解析：艾叶的应用于出血证，本品气香味辛，温可散寒，能暖气血而温经脉，为温经止血之要药，适用于虚寒性的出血病症，对妇女崩漏下血尤为适宜（D对）。白茅根的应用于血热出血证，本品味甘性寒入血分，能清血分之热而凉血止血，可用治多种血热出血证（A错）。大蓟的应用于血热出血证，本品寒凉而入血分功能凉血止血，主治血热妄行之诸出血证，尤多用于吐血，咯血及崩漏下血（B错）。地榆的应用于血热出血证（C错）。蒲黄的应用于出血证 ，瘀血痛症 ，血淋尿血的治疗（E错）。